治疗肠内外各型阿米巴病首选药物是
A. 吐根碱
B. 灭滴灵
C. 氯喹
D. 喹碘仿
E. 卡巴砷

正确答案：B。灭滴灵

解析：硝基咪唑类为治疗阿米巴首选，灭滴灵即甲硝唑属于此类（B对）。（八版传染病学未详细说明）吐根碱、喹碘仿、卡巴砷（ADE错）均能直接杀灭阿米巴滋养体，但不作为首选。氯喹（C错）为目前非耐药疟疾的首选药。